下列锉针手柄的颜色与25号根管锉针相对应的是
A. 紫
B. 红
C. 白
D. 蓝
E. 黑

正确答案：B。红

解析：锉针手柄颜色：从15#起分别以白、黄、红、蓝、绿、黑六种颜色标记为一组，装于一个包装盒内。掌握“髓腔进入与初预备”知识点。